患者，女，30岁。因进食海鲜后，四肢出现出血点，对称分布。检查：血象脆性嗜酸粒细胞偏高，骨髓象正常，毛细血管脆性试验阳性。应首先考虑的是
A. 过敏性紫癜
B. 败血症
C. 急性粒细胞白血病
D. 急性型原发性血小板减少性紫癜
E. 慢性型原发性血小板减少性紫癜

正确答案：A。过敏性紫癜

解析：本例患者为青年女性，进食海鲜后四肢出现出血点，对称分布，血象可见脆性嗜酸粒细胞偏高，毛细血管脆性试验阳性，故诊断首先考虑的是过敏性紫癜（A对）。过敏性紫癜是一种常见的血管变态反应性疾病，因机体对某些致敏物质产生变态反应，导致毛细血管脆性和通透性增加，血液外渗，产生紫癜、黏膜及某些器官出血。败血症（B错）常继发于急性感染，主要表现为畏寒、寒战、高热，部分患者也可出现皮肤紫癜。急性粒细胞白血病（C错）主要表现为贫血、发热和出血，部分患者血象可见白细胞增多并出现原始细胞，骨髓象可见增生明显活跃。急性型原发性血小板减少性紫癜（D错）和慢性型原发性血小板减少性紫癜（E错）主要表现为出血、乏力、贫血，血象可见血小板计数减少，骨髓象可见巨核细胞发育成熟障碍，出血时间延长。